中耳鼓室
A. 位于外耳道与内耳道之间，是一密闭的腔
B. 经咽鼓管通咽腔
C. 上壁称鼓室盖，与颅后窝毗邻
D. 内侧壁上有听觉感受器
E. 无

正确答案：B。经咽鼓管通咽腔

解析：鼓室是颞骨岩部内含气的不规则小腔（A错）。鼓室是中耳的组成部分，经咽鼓管通咽腔（B对）。上壁又称盖壁，分隔鼓室与颅中窝（C错）。内耳的膜迷路的螺旋膜上有螺旋器，又称Corti 器，是听觉感受器（D错）。